痄腮之毒窜睾腹证，治疗首选
A. 清瘟败毒饮
B. 龙胆泻肝汤
C. 普济消毒饮
D. 犀角地黄汤
E. 黄连解毒汤

正确答案：B。龙胆泻肝汤

解析：该题考查小儿痄腮证型以及方药。龙胆泻肝汤治疗痄腮之毒窜睾腹证，治法清肝泻火，活血止痛。（B对）。清瘟败毒饮治疗痄腮变证邪陷心肝（A错）。普济消毒饮治疗痄腮之热毒壅盛（C错）。犀角地黄汤治疗流行性乙型脑炎（D错）。黄连解毒汤未用于治疗小儿痄腮（E错）。